药品监督管理部门在对甲药品经营且监督检查中发现，该企业《药品经营许可证》核定的经营方式为零售（连锁），经营范围为中药饮片、中成药、化学药制剂、抗生素制剂。《药品经营许可证》发证时间为2014年10月8日，检查人员现场检查时还发现，在货架上摆放有生物制品人血白蛋白。对货架上摆放人血白蛋白行为的说法，正确的是
A. 人血白蛋白属于西药制剂，未超出该企业许可经营范围
B. 违规销售生物制品，属于超许可证经营的范围的行为
C. 人血白蛋白尚未售出，不应按超经营范围处置
D. 不明原因的陈列生物制品，不属于违反药品经营质量管理规定的行为

正确答案：B。违规销售生物制品，属于超许可证经营的范围的行为

解析：本题考查的是药品经营范围。药品监督管理部门在对甲药品经营且监督检查中发现，该企业《药品经营许可证》核定的经营方式为零售（连锁），经营范围为中药饮片、中成药、化学药制剂、抗生素制剂。《药品经营许可证》发证时间为2014年10月8日，检查人员现场检查时还发现，在货架上摆放有生物制品人血白蛋白。对货架上摆放人血白蛋白行为的说法，正确的是违规销售生物制品，属于超许可证经营的范围的行为（B对）。根据题干可知人血白蛋白为生物制品，甲药品经营企业的经营范围为中药饮片、中成药、化学药制剂、抗生素制剂，故不能销售生物制品。药品经营范围包括：麻醉药品、第一类精神药品、第二类精神药品、药品类易制毒化学品、医疗用毒性药品、生物制品、药品类体外诊断试剂、中药饮片、中成药、化学药。其中，麻醉药品、精神药品、药品类易制毒化学品、医疗用毒性药品等经营范围的核定，按照国家有关规定执行；经营冷藏、冷冻药品或者蛋白同化制剂、肽类激素的，还应当在《药品经营许可证》经营范围项下予以明确。麻醉药品、第一类精神药品、药品类易制毒化学品及蛋白同化制剂、胰岛素外的肽类激素等不得列入药品零售企业持有的药品经营许可证的经营范围内。